思维的重要特征是
A. 抽象性和创造性
B. 深刻性和观念性
C. 上升性和决策性
D. 分析性和综合性
E. 间接性和概括性

正确答案：E。间接性和概括性